对蒿甲醚描述错误的是
A. 临床使用的是α构型和β构型的混合物
B. 在水中的溶解度比较大
C. 抗疟作用比青蒿素强
D. 在体内主要代谢物为双氢青高素
E. 对耐氯喹的恶性疟疾有较强活性

正确答案：B。在水中的溶解度比较大